急性心肌梗死早期最重要的治疗措施是
A. 抗心绞痛
B. 消除心律失常
C. 补充血量
D. 心肌再灌注
E. 增加心肌营养

正确答案：D。心肌再灌注

解析：急性心肌梗死早期最重要的治疗措施是实现心肌再灌注（D对），这对挽救濒死的心肌、防止梗死扩大或缩小心肌缺血范围具有重要意义，并且能够保护和维持心脏功能、解除疼痛。再灌注治疗前可选用药物解除心绞痛，但对于梗死的心肌并无多大作用（A错）。消除心律失常（B错）是急性心肌梗死的治疗原则之一，以免其演变为严重心律失常甚至猝死，但并非早期最重要的治疗措施。补充血量（C错）仅为血容量不足时的抗休克治疗。增加心肌营养（E错）为急性心肌梗死时的辅助治疗措施，可促进心肌摄取和代谢葡萄糖，以利心脏的正常收缩，减少心律失常。